关于左肾毗邻，下列哪项叙述是错误的
A. 上方有肾上腺附着
B. 前方上部邻胃底后面
C. 前方下部为结肠左曲
D. 前方中部有十二指肠横过
E. 内侧有腹主动脉

正确答案：D。前方中部有十二指肠横过

解析：左肾上方有肾上腺附着（A对），前方上部邻胃底后面（B对），前方下部为结肠左曲（C对）。前方中部有十二指肠横过为右肾的特点（D错，为本题正确答案）。如图所示，左肾内侧有腹主动脉（E对），右肾内侧有下腔静脉。